脱肛外治法的治疗原则是
A. 熏洗、外敷
B. 涂药、烙法
C. 收敛、固涩
D. 熨法、热烘
E. 针灸、垫棉

正确答案：C。收敛、固涩

解析：脱肛是直肠黏膜、肛管、直肠全层和部分乙状结肠向下移位而脱出肛门外的一种疾病，其特点是以直肠黏膜及直肠反复脱出肛门外伴肛门松弛，相当于西医的直肠脱垂，其外治宜收敛、固涩为主，以苦参汤加石榴皮、枯矾、五倍子，煎水熏洗，每日2次；以五倍子散或马勃散外敷（C对）。熏洗、外敷，涂药、烙法，熨法、热烘和针灸、垫棉是治疗方法，不是治疗原则（ABDE错）。